临床试验设计时，实验组与对照组的主要差别是
A. 对病例诊断要求不一样
B. 实验组给予某处理因素，而对照组没有
C. 对照组给予某处理因素，而实验组没有
D. 实验组与对照组观察结果的方法不一样
E. 两者观察所需时间不一样

正确答案：B。实验组给予某处理因素，而对照组没有

解析：本题考查临床试验中实验组和对照组的差别。临床试验的对照组和实验组一样，均为患病的病人。两者的不同之处在于对照组和实验组的处理因素不同，实验组会接受某种处理因素，而对照组不会接受该种处理因素（B对ACDE错），其它基线信息尽可能保持一致，以增加可比性。